某男，32岁。近3日其所在单位多人发热，患者1天前突然发热，高热不退，周身酸痛，无汗，口干咽喉疼痛，舌质红，苔黄，脉浮数。应选用的中医治法是
A. 辛凉解表
B. 辛温解表
C. 益气解表
D. 解表除湿
E. 清热解毒

正确答案：E。清热解毒

解析：本题考查的是感冒的辨证论治。近3日其所在单位多人发热，患者1天前突然发热，高热不退，周身酸痛，无汗，口干咽喉疼痛，舌质红，苔黄，脉浮数。应选用的中医治法是清热解毒（E对）。感冒是感受风邪或时行病毒，卫表失和而导致的常见外感疾病，临床表现以鼻塞、流涕、喷嚏、头痛、恶寒、发热、全身不适、脉浮等为特征。西医学中普通感冒（伤风）、流行性感冒（时行感冒）及其他上呼吸道感染，有上述临床表现者可参考此内容辨证论治。（一）风寒感冒：【症状】恶寒重，发热轻，无汗头痛，肢体酸痛，或鼻塞声重，或鼻痒喷嚏，流涕清稀，咽痒，咳嗽，咳痰稀白。舌苔薄白，脉浮紧。【治法】辛温解表（B错），宣肺散寒。（二）风热感冒：【症状】身热较著，微恶风，头胀痛，或咳嗽少痰，或痰出不爽，咽痛咽红，口渴。舌边尖红，苔薄白或微黄，脉浮数。【治法】辛凉解表（A错），宣肺清热。（三）时行感冒：【症状】突然发热，高热不退，甚则寒战，周身酸痛，无汗，咳嗽，口干，咽喉疼痛，伴明显全身症状，呈现流行性发作。舌红，苔黄，脉浮数。【治法】清热解毒，凉血泻火。（四）气虚感冒：【症状】发热，恶寒较甚，无汗，头痛鼻塞，身楚倦怠，咳嗽，痰白，咳痰无力。舌淡，苔白，脉浮而无力。【治法】益气解表（C错）。治法为解表除湿（D错）的病证，2022年考试指南未明确说明。